外源化学物生物转化的两重性表现在
A. N-氧化.苯胺N羟基苯胺（毒性增强）
B. 脱硫反应，对硫磷对氧磷（水溶性增加，毒性增强）
C. 环氧化，苯并（α）芘7，8-二醇-9，10环氧化物（致癌）
D. 以上都是生物转化两重性的典型例子

正确答案：D。以上都是生物转化两重性的典型例子

解析：本题考查外源化学物生物转化的两重性。外源化学物生物转化的两重性表现在：N-氧化.苯胺N羟基苯胺（毒性增强）；脱硫反应，对硫磷对氧磷（水溶性增加，毒性增强）；环氧化，苯并（α）芘7，8-二醇-9，10环氧化物（致癌）（D对ABC错）。